有关公共卫生伦理学哪项理解不正确
A. 强调资源分配的公平
B. 研究对象是社会公众，健康人
C. 关注问题有预防、防止伤害发生、传染病流行；人权，政治性色彩强
D. 研究侧重在影响健康的行为、生活方式等社会因素，落足于政策制定
E. 涉及单一的医患关系

正确答案：E。涉及单一的医患关系